口腔一般感觉的敏感性依次为
A. 痛觉﹥压觉﹥冷觉﹥温觉
B. 压觉﹥冷觉﹥温觉﹥痛觉
C. 冷觉﹥温觉﹥痛觉﹥压觉
D. 温觉﹥痛觉﹥压觉﹥冷觉
E. 痛觉﹥温觉﹥冷觉﹥压觉

正确答案：A。痛觉﹥压觉﹥冷觉﹥温觉

解析：本题考查口腔感觉。口腔一般感觉的敏感性依次为痛觉﹥压觉﹥冷觉﹥温觉（A对）。口腔感觉主要包括痛觉、温度觉（冷觉热觉）、触压觉、本体感觉和味觉。口腔一般感觉的敏感性依次为：痛觉＞压觉＞冷觉＞温觉。口腔前部感觉点较密，口腔后部感觉点较稀，因此，口腔前部有舌神经的分支所以一般感觉较口腔后部敏感。